根尖诱导术后牙根能否继续形成取决于
A. 是否有残留的活的根髓
B. 是否炎症得到控制
C. 根管内感染坏死牙髓是否去尽
D. 病人身体是否健康
E. 牙乳头和上皮根鞘是否存活

正确答案：E。牙乳头和上皮根鞘是否存活

解析：本题考查根尖诱导术的修复机制与愈合类型。根尖诱导术后牙根能否继续形成取决于牙乳头和上皮根鞘是否存活（E对）。通过根尖部残留的生活牙髓细胞的分化或分化产生牙本质样细胞，沉积牙本质，继续发育牙根，所形成的牙根近似正常牙根。牙髓破坏后，根尖端存活的牙乳头，也可分化成牙本质细胞，使牙根继续发育。牙髓坏死并发根尖周炎症，当感染控制炎症消除后，幸存的上皮根鞘或是上皮根鞘功能得以恢复，也可使根端闭合。根尖部的牙髓、牙乳头及上皮根鞘是根尖诱导形成的组织基础。残留的活的根髓（A错）必须是根尖部的，其他部位的则不能在根尖诱导术后继续形成根尖。彻底消除根管内感染物质是消除根尖周围炎症和促进根尖形成的重要因素。炎症是否得到控制（B错），根管内感染坏死牙髓是否去尽（C错）以及病人身体是否健康（D错）都是影响根尖诱导术后牙根能否继续形成的重要因素，但不是决定性因素。